关于肝炎病毒与传播途径的组合，哪项是错误的
A. HAV-消化道传播
B. HBV-输血和注射
C. HCV-输血和注射
D. HDV-输血和注射
E. HEV-输血和注射

正确答案：E。HEV-输血和注射

解析：戊型病毒性肝炎其流行特点似甲型肝炎，经口-粪（包括动物粪便）途径传播，具有明显季节性，多见于雨季或洪水之后，无慢性化，愈后良好。掌握“丙型、丁型、戊型肝炎病毒”知识点。